生后7～9个月添加的辅食是
A. 果汁、菜汁、鱼肝油
B. 铁剂
C. 蛋黄
D. 肉末、豆腐、芋头
E. 果泥、菜泥、米糊

正确答案：D。肉末、豆腐、芋头

解析：生后7～9个月添加的辅食是肉末、豆腐、芋头（D对）。生后1～3个月添加的辅食是果汁、菜汁、鱼肝油（A错），对于早产儿，宜自2个月给予铁剂预防，足月儿一般不添加铁剂（B错），及时添加含铁丰富的辅食即可。蛋黄（C错）在生后7个月添加。生后4～6个月添加的辅食是果泥、菜泥、米糊（E错）。